中医四诊的道德要求是
A. 安神定志
B. 认真负责
C. 保守医密
D. 知情同意
E. 尊重患者

正确答案：A。安神定志

解析：1、中医四诊的道德要求（1）安神定志 早在《素问·征四失论》中就指出：“精神不专，志意不理”是医生失误的重要原因之一。为了排除医生主观因素的干扰，中医诊断疾病非常强调安神定志（A对）。（2）实事求是 要求医生忠实反映症状的客观真实性。辨证是以症状为依据的，通过四诊所获得的症状是否客观，将直接影响到辨证的正确与否，进而影响到治疗的正确与否（BCDE错）。